可以使细胞呼吸停止，引起机体迅速死亡的氧化磷酸化的抑制剂是
A. ATP合酶抑制剂
B. 解偶联剂
C. 呼吸链抑制剂
D. 2,4-二硝基酚（DNP）
E. 寡霉素

正确答案：C。呼吸链抑制剂

解析：呼吸链抑制剂能够阻断呼吸链中某部位电子传递而使氧化受阻的物质（药物或毒物），此类抑制剂可使细胞呼吸停止，引起机体迅速死亡。掌握“氧化磷酸化”知识点。